关于药典与药品标准的叙述，错误的是
A. 我国现行药品标准有《中国药典》和局（部）颁标准
B. 药品标准是药品生产、供应、使用、检验和管理的法定依据
C. 《新修本草》是我国也是世界上最早的一部全国性药典
D. 除2005年版外，已颁布的《中国药典》均分为一、二两部
E. 《太平惠民和剂局方》是我国第一部由官方颁布的制剂规范，具有准药典的性质

正确答案：D。除2005年版外，已颁布的《中国药典》均分为一、二两部

解析：本题考查药品标准组成。关于药典与药品标准的叙述，错误的是除2005年版外，已颁布的《中国药典》均分为一、二两部（D错，为本题正确答案）。药品标准组成：1.《中国药典》2.部/局颁标准（A对）3.进口药材标准4.药品注册标准5.省、自治区、直辖市中药材标准6.省、自治区、直辖市中药饮片炮制规范7.企业标准。省、自治区、直辖市中药饮片炮制规范：省、自治区、直辖市中药饮片炮制规范继承地方传统饮片炮制方法，保留其特有传统工艺，继承、整理和挖掘地方炮制经验技术，总结长期在饮片生产第一线、具有丰富生产经验的“老药工”的实践经验，收载有地方炮制特色或中医用药特点的饮片品规及其炮制技术，是对国家药品标准中未收载的地方临床习用饮片品规和炮制方法的补充，是地方饮片加工、生产、经营、使用、检验、监督管理的法定依据（B对）。《新修本草》又称《唐本草》，为隋唐时期唐代的本草代表作。本书的完成依靠了国家的行政力量和充足的人力物力，是我国历史上第一部官修药典性本草，并被今人誉为世界上第一部药典（C对），比公元1546年问世的欧洲纽伦堡药典《科德药方书》早887年。宋、元时期是中药成方制剂初具规模，得到巨大发展的时期。由太医院颁布的《太平惠民和剂局方》，该书为我国历史上由官方颁发的第一部制剂规范（E对），可视为中药药剂发展史上的第一个里程碑。《中国药典》现行药典，分为一、二、三和四部。